被动免疫不用于下列哪种疾病的预防或治疗
A. 白喉
B. 破伤风
C. 麻疹
D. 甲型肝炎
E. 细菌性痢疾

正确答案：E。细菌性痢疾

解析：本题考查被动免疫。人工被动免疫是将含有特异性抗体的血清或制剂接种人体，使机体被动地获得特异性免疫力而受到保护。被动免疫可用于白喉（A对）、破伤风（B对）、麻疹（C对）、甲型肝炎（D对）的预防或治疗，不用于细菌性痢疾（E错，为本题正确答案）的预防或治疗。